根据《处方管理办法》，关于进修医师处方权的说法，正确的是
A. 进修医师在进修的医疗机构不具有处方权
B. 进修医师在进修的医疗机构中具有与原单位相同的处方权
C. 进修医师在进修的医疗机构对其胜任本专业工作的实际情况进行认定后授予相应的处方权
D. 进修医师在进修的医疗机构所在的卫生行政部门组织的统一考试后授予相应的处方权
E. 进修医师开具的处方，应当经进修的医疗机构临床科室主任审核并签名后方有效

正确答案：C。进修医师在进修的医疗机构对其胜任本专业工作的实际情况进行认定后授予相应的处方权

解析：本题考查处方权的获得。根据《处方管理办法》关于进修医师处方权的说法，正确的是进修医师在进修的医疗机构对其胜任本专业工作的实际情况进行认定后授予相应的处方权（C对）。《处方管理办法》第三章处方权的获得第十三条：进修医师由接收进修的医疗机构对其胜任本专业工作的实际情况进行认定后授予相应的处方权。